支气管哮喘患者PaCO₂增高表明
A. 病情好转
B. 病情稳定
C. 病情危重，需要机械通气
D. 出现呼吸性碱中毒
E. 合并心力衰竭，需要使用利尿剂

正确答案：C。病情危重，需要机械通气

解析：支气管哮喘是一种以慢性气道炎症和气道高反应性为特征的异质性疾病。严重哮喘发作时可出现缺氧，由于过度通气可使PaCO₂下降，pH上升，表现为呼吸性碱中毒，若病情进一步恶化，可同时出现缺氧和CO₂滞留，表现为呼吸性酸中毒（D错）。当患者出现以下3个指征时：呼吸肌疲劳、PaCO₂≥45mmHg、意识改变，则需要给予机械通气治疗，不代表出现心力衰竭，无需使用利尿剂。哮喘不能使用利尿剂，而且还需要补液，因为患者紧张和过度通气会导致气道干燥（C对ABE错）。PaCO₂增高可能存在呼吸性酸中毒，但不会出现呼吸性碱中毒（D错）。